护肝片除疏肝理气外，又能
A. 消肿止痛
B. 益气和营
C. 益中健脾
D. 健脾消食
E. 健脾养血

正确答案：D。健脾消食

解析：本题考查的是护肝片的功能。护肝片除疏肝理气外，又能健脾消食（D对）。护肝片：【功能】疏肝理气，健脾消食。紫金锭：【功能】辟瘟解毒，消肿止痛（A错）。薯蓣丸：【功能】调理脾胃，益气和营（B错）。加味逍遥丸：【功能】疏肝清热，健脾养血（E错）。功能为益中健脾（C错）的中成药，2022年考试指南未明确说明。